《中共中央、国务院关于深化医药卫生体制改革的意见》提出的医药卫生体制改革的基本原则包括
A. 立足国情
B. 以人为本
C. 统筹兼顾
D. 政事分开
E. 公平与效率统一

正确答案：A、B、C、E。立足国情；以人为本；统筹兼顾；公平与效率统一

解析：本题考查深化医药卫生体制改革的基本原则。深化医药卫生体制改革的基本原则：①坚持以人为本（B对），把维护人民健康权益放在第一位；②坚持立足国情（A对），建立中国特色医药卫生体制；③坚持公平与效率统一（E对），政府主导与发挥市场机制作用相结合；④坚持统筹兼顾（C对），把解决当前突出问题与完善制度体系结合起来。